增强子的作用是
A. 促进结构基因转录
B. 抑制结构基因转录
C. 抑制阻遏蛋白
D. 抑制操纵基因表达
E. 抑制启动子

正确答案：A。促进结构基因转录

解析：真核基因顺式作用元件影响基因转录活性。其中增强子就是远离转录起点、决定基因的时间、空间特异性表达、增强启动子转录活性的DNA序列。其发挥作用的方式通常与方向、距离无关。启动子是原核操纵子中的启动序列。掌握“基因表达调控原理”知识点。